经营乙类非处方药的商业企业必须
A. 持有《药品经营许可证》
B. 配备执业药师
C. 配备从业药师
D. 配备药学专业技术人员
E. 经省级或其授权的药品监督管理部门批准

正确答案：E。经省级或其授权的药品监督管理部门批准

解析：本题考查处方药。经营乙类非处方药的商业企业必须经省级或其授权的药品监督管理部门批准（E对）。《处方药与非处方药分类管理办法（试行）》第八条：根据药品的安全性，非处方药分为甲、乙两类。经营处方药、非处方药的批发企业和经营处方药、甲类非处方药的零售企业必须具有《药品经营许可证》。经省级药品监督管理部门或其授权的药品监督管理部门批准的其他商业企业可以零售乙类非处方药。